直肠癌患者术前判断局部侵犯及转移状况，最主要的检查方法是
A. 肿瘤标志物
B. 钡剂灌肠检查
C. CT
D. B超
E. 直肠镜

正确答案：C。CT

解析：肿瘤标志物（A错）缺乏对早期结、直肠癌的诊断价值，CEA主要用于评估肿瘤负荷和监测术后复发。钡剂灌肠检查（B错）对诊断结肠癌有很大的价值（P389）。CT主要用于评估多发于肝、肺的远处转移。因此直肠癌患者术前判断局部侵犯及转移状况，最主要的检查方法是CT（C对）。B超（D错）对直肠癌T分期的敏感性、特异性高。直肠镜（E错）只能观察大肠部分，对于远处转移不能判断。